下合穴的主治是
A. 体重节痛
B. 逆气而泄
C. 五脏病症
D. 六腑病症
E. 喘咳寒热

正确答案：D。六腑病症

解析：该题主要考查特定穴的应用。下合穴是特定穴的一种，它指的是六腑之气合于下肢足三阳经的六个腧穴，主治六腑病证（D对）。输主体重节痛（A错）。合主逆气而泄（B错）。背俞穴主要用于治疗脏腑病症（C错）。经主喘咳寒热（E错）。